乳腺癌患者发现同侧腋下及胸骨旁有淋巴结转移，但一般情况尚可，应采取
A. 乳癌扩大根治术
B. 单纯乳房切除术
C. 乳癌根治术
D. 改良根治术
E. 放疗加化疗

正确答案：A。乳癌扩大根治术

解析：乳腺癌患者发现同侧腋下及胸骨旁有淋巴结转移，在临床上属于Ⅲ期乳腺癌，考虑到胸骨旁淋巴结转移情况，宜采用乳癌扩大根治术（A对），该手术方式包括整个乳房、胸大肌、胸小肌、腋窝及锁骨下淋巴结的整块切除，可清除腋下组（胸小肌外侧）、腋中组（胸小肌深面）及腋上组（胸小肌内侧） 三组淋巴结，同时切除第2 、3 肋软骨及相应的肋间肌、胸廓内动、静脉及其周围淋巴结（即胸骨旁淋巴结）。患者基本情况良好，考虑到远期生存时间和耐受手术情况，乳癌扩大根治术为最适合手术方案。